丙型肝炎病毒（HCV）的主要传播途径是
A. 虫媒传播
B. 输血传播
C. 垂直传播
D. 呼吸道传播
E. 消化道传播型肝炎类似主要是进行血液传播。掌握“黄病毒”知识点。

正确答案：B。输血传播